人类赖以生存的自然环境包括地球上的
A. 气圈、水圈、土壤圈、食物链
B. 气圈、水圈、土壤圈、食物圈
C. 气圈、水圈、土壤圈、岩石圈
D. 气圈、水圈、土壤圈、生物圈
E. 气圈、水圈、岩石圈、食物链

正确答案：D。气圈、水圈、土壤圈、生物圈

解析：本题考查自然环境。人类赖以生存的自然环境包括地球上的大气圈、水圈、土壤岩石圈、生物圈（D对ABCE错）。